文化是
A. 语言
B. 文字
C. 物质财富
D. 艺术
E. 一种思考与行动的范型

正确答案：E。一种思考与行动的范型